被称为“滤泡囊肿”的是
A. 始基囊肿
B. 含牙囊肿
C. 角化囊肿
D. 根尖囊肿
E. 鳃裂囊肿

正确答案：B。含牙囊肿

解析：本题考查被称为“滤泡囊肿”的牙源性囊肿。含牙囊肿（B对）发生于牙冠或牙根形成之后，在缩余釉上皮与牙冠面之间出现液体渗出而形成含牙囊肿，又称滤泡囊肿。始基囊肿（A错）发生于成釉器发育的早期阶段，牙釉质和牙本质形成之前，在炎症和损伤刺激后，成釉器的星型网状层发生变性，并有液体渗出，蓄积其中而形成囊肿。角化囊肿（C错）来源于原始的牙胚或牙板残余。根尖囊肿（D错）是由于根尖肉芽肿，慢性炎症的刺激，引起牙周膜的上皮残余增生，增生上皮团中央发生变性与液化，周围组织也不断渗出，逐渐形成囊肿，亦称为根尖周囊肿。鳃裂囊肿（E错）属于鳃裂畸形的一种，来源于鳃裂的上皮残余。